营养腭扁桃体的动脉发自
A. 甲状腺上动脉
B. 舌动脉
C. 面动脉
D. 舌动脉和面动脉
E. 无

正确答案：D。舌动脉和面动脉

解析：营养腭扁桃体的动脉发自舌动脉和面动脉（D对）。